生物转运过程是指
A. 吸收、分布、代谢
B. 吸收、分布、排泄
C. 分布、代谢、排泄
D. 吸收、代谢
E. 代谢、排泄

正确答案：B。吸收、分布、排泄